粉末显微特征中，石细胞类圆形或类方形，壁厚，有的一面菲薄；油细胞类圆形或长圆形的药材是
A. 合欢皮
B. 秦皮
C. 肉桂
D. 杜仲
E. 厚朴

正确答案：C。肉桂

解析：本题考查的是肉桂的显微鉴别。粉末显微特征中，石细胞类圆形或类方形，壁厚，有的一面菲薄；油细胞类圆形或长圆形的药材是肉桂（C对）。肉桂：【显微鉴别】粉末：纤维大多单个散在，长梭形，直径约至50μm，壁厚，木化，纹孔不明显。石细胞类圆形或类方形，壁厚，有的一面菲薄，直径32～88μm。油细胞类圆形或长圆形。厚朴（E错）：【显微鉴别】粉末厚朴、姜厚朴：石细胞类方形、椭圆形或不规则分枝状，直径11～65μm，壁厚，有的可见层纹。油细胞椭圆形或类圆形，含黄棕色油状物。纤维甚多，壁甚厚，有的呈波浪形或一边呈锯齿状，木化，孔沟不明显。